一种筛检乳腺癌的实验，应用于已经病理检查证实的乳腺癌患者400人和未患乳腺癌400人。结果患癌组有100例阳性，未患癌组有50例阳性。该试验的阳性预测值为
A. 100/400
B. 350/400
C. 100/150
D. 100/300
E. 350/650

正确答案：C。100/150

解析：本题考查阳性预测值的计算。阳性预测值是指筛检发现的阳性者中患目标疾病的人所占的比例。根据图中数据代入公式得出阳性预测值＝TP/（FP+TP）＝100/150（C对ABDE错）。